引起病毒性心肌炎最常见的病毒是
A. 风疹
B. 呼吸道合胞病毒
C. 流感
D. 单纯性疱疹
E. 柯萨奇B组病毒

正确答案：E。柯萨奇B组病毒

解析：引起病毒性心肌炎最常见的病毒是柯萨奇B组病毒（E对）。风疹病毒（A错）、呼吸道合胞病毒（B错）和流感病毒（C错）也可引起病毒性心肌炎，但较少见。单纯性疱疹病毒（D错）极少引起病毒性心肌炎，常引起单纯疱疹（一种皮肤病）。